肱骨体后面中份的斜行沟是
A. 尺神经沟
B. 解剖颈
C. 结节间沟
D. 外科颈
E. 桡神经沟

正确答案：E。桡神经沟

解析：肱骨体后面中部可见自内上斜向外下的浅沟，称桡神经沟 （E对）。内上髁后方的浅沟称尺神经沟 （A错）。头周围的环状浅沟，称解剖颈（B错）。肱骨大小两结节间的纵沟称结节间沟（C错）。肱骨上端与体交界处稍细，称外科颈 （D错）。